胸胁支满，目眩心悸，短气而咳，舌苔白滑，脉弦滑者，治宜选用
A. 十枣汤
B. 五苓散
C. 真武汤
D. 五皮散
E. 苓桂术甘汤

正确答案：E。苓桂术甘汤

解析：该题考查苓桂术甘汤的主治病证。题中心悸，短气而咳的症状尤为重要，综合舌脉可知为中阳不足，痰饮内生，水凌心肺的病证。十枣汤功能攻逐水饮，主治悬饮及水肿（A错）。五苓散功能利水渗湿，温阳化气，主治膀胱气化不利之蓄水证（B错）。真武汤功能温阳利水，主治阳虚水泛证（C错）。五皮散功能利水消肿，理气健脾，主治脾虚湿盛，气滞水泛之皮水证（D错）。苓桂术甘汤功能温阳化饮，健脾利湿，主治中阳不足之痰饮（E对）。